上颌窦口位于
A. 上颌骨体内侧面
B. 上颌骨体上面
C. 上颌骨的颞下面
D. 上颌骨牙槽突
E. 上颌骨腭突

正确答案：A。上颌骨体内侧面

解析：上颌骨鼻面构成鼻腔外侧壁，后份有大的上颌窦裂孔，通入上颌窦（A对）。